10～15个/HP，RBC满视野，该患者最可能的诊断是
A. 细菌性痢疾
B. 肠伤寒合并肠出血
C. 阿米巴痢疾
D. 溃疡性结肠炎
E. 血吸虫病

正确答案：C。阿米巴痢疾

解析：大便镜检：WBC每高倍视野10-15个，RBC满视野，为典型的脓血便。患者无发热，右下腹隐痛，腹泻，粘液脓血便，且便量多，为暗红色，有腥臭味，该患者最可能的诊断是阿米巴痢疾（P273）（C对）。细菌性痢疾（P178）（A错）起病急，常有畏寒高热，可有粘液脓血便，但每次便量少，常伴里急后重。肠伤寒（P149）（B错）多表现为长期高热，恶心呕吐，右下腹痛，腹泻，但腹泻较轻，肠出血多发生于病程2-3周，有内出血表现。溃疡性结肠炎（D错）常有粘液脓血便，但粪便无腥臭味。血吸虫病（P297）（E错）常有血吸虫疫水接触史，有发热、过敏反应及消化道症状。